下列有关三臂卡环的叙述，说法正确的是
A. 属于标准的圈形卡环
B. 卡环的稳定作用较差
C. 多用于牙冠外形倾斜的基牙
D. 卡环包绕基牙的3个或4个轴面角
E. 卡环由颊、舌两个卡环臂组成

正确答案：D。卡环包绕基牙的3个或4个轴面角

解析：三臂卡环：多用于牙冠外形好，无明显倾斜的基牙。卡环由颊、舌两个卡环臂和（牙合）支托组成。包绕基牙的3个或4个轴面角，小连接体和（牙合）支托连接，属于标准的圆环卡环，应用最为广泛，卡环的固位、支持和稳定作用均好。掌握“局部义齿固位体”知识点。